鉴别上下尿路感染的依据是
A. 中段尿细菌培养
B. 尿抗体包裹细菌检查
C. 尿蛋白定量
D. 3小时尿白细胞计数
E. 尿中脓细胞检查

正确答案：B。尿抗体包裹细菌检查

解析：上尿路感染时，细菌侵犯肾组织产生抗体反应，特异性抗体逐渐包裹在该细菌的表面。尿抗体包裹细菌检查（B对）用荧光素标记的抗人球蛋白抗体处理尿沉渣中的细菌，观察其表面有无抗体包裹，若阳性则证明是上尿路感染，阴性则证明是下尿路感染。中段尿细菌培养（A错）、3小时尿白细胞计数（D错）及尿中脓细胞检查（E错）均有助于诊断尿路感染，但上下尿路感染均可出现上述表现，故其不是鉴别上下尿路感染的依据。尿蛋白定量（C错）有助于肾病综合症的诊断，但对于诊断尿路感染意义不大，故其不是鉴别上下尿路感染的依据。